当固定桥两端固位力不相等时会引起
A. 一端基牙的骨吸收
B. 一端基牙的松动
C. 一端固位体的磨耗
D. 一端固位体的松动
E. 整个固定桥的弯曲

正确答案：D。一端固位体的松动

解析：基牙两端的固位体固位力应基本相等，若两端固位体的固位力相差悬殊时，固位力较弱的一端固位体与基牙之间易松动。掌握“固定桥的设计”知识点。